某山区一妇女育有3个子女，生活贫困，长期从事重体力劳动。近期感觉头昏乏力，血白蛋白下降，水肿，最需要补充的食物是什么
A. 白面
B. 红薯
C. 绿叶菜
D. 大米
E. 豆类相关制品

正确答案：E。豆类相关制品

解析：该妇女最需要补充豆类相关制品（E对）。根据该患者的病史并结合临床症状：生活贫困，多孕多产，头昏乏力，血白蛋白下降，水肿。不难诊断该患者为蛋白质-热能营养不良中恶性营养不良型的表现。应该及时补充蛋白质。豆类相关制品可提供足够丰富的优质蛋白质，且价格比动物性蛋白便宜。白面（A错）、红薯（B错）、大米（D错）主要含有的是淀粉一类的碳水化合物，提供热能为主，蛋白质含量少且吸收利用率较低。绿叶菜（C错）补充的主要是维生素，对蛋白质-热能营养不良的治疗并没有太大的治疗意义。